下面关于第四脑室的说法何者正确
A. 位于延髓、脑桥和小脑之间
B. 借中脑水管与蛛网膜下腔相通
C. 底是菱形窝,顶朝向脑干
D. 无脉络丛
E. 无

正确答案：A。位于延髓、脑桥和小脑之间

解析：第四脑室位于延髓、脑桥和小脑之间（A对），其底为菱形窝，两侧角为外侧隐窝，顶向后上朝向小脑蚓（C错）。第四脑室后下部由下髓帆及第四脑室脉络组织形成。脉络组织内的部分血管反复分支，相互缠绕成丛状，夹带着室管膜上皮和软膜突入室腔，成为第四脑室脉络丛（D错），产生脑脊液。脑脊液在第四脑室内向上经中脑导水管通第三脑室（B错），向下可达延髓下部和脊髓的中央管，并借脉络组织上的3个孔与蛛网膜下隙相通。